血浆细胞合成的蛋白质是
A. 清蛋白
B. γ-球蛋白
C. 凝血酶原
D. 纤维粘连蛋白
E. 纤维蛋白原

正确答案：B。γ-球蛋白

解析：绝大多数血浆蛋白质在肝合成，如白蛋白、纤维蛋白原和纤连蛋白等。还有少量的蛋白质是由其他组织细胞合成的，如γ-球蛋白是由浆细胞合成的。掌握“血液成分及血浆蛋白”知识点。